高血压患者服用吲达帕胺和氨氯地平，应注意检测
A. 血常规
B. 血钾
C. 血肌酐
D. 血丙氨酸转移酶
E. 血ph

正确答案：B。血钾

解析：吲达帕胺虽无噻嗪环但有磺胺结构，利尿作用于噻嗪类相似，不良反应易引起电解质紊乱（B对）。